治疗阵发性室上性心动过速可使用
A. 奎尼丁
B. 维拉帕米
C. 利多卡因
D. 普萘洛尔
E. 普鲁卡因胺

正确答案：B。维拉帕米

解析：维拉帕米（B对）阻滞心肌细胞膜的L-型钙通道，抑制钙离子内流，对IKr钾通道也有抑制作用，能够降低窦房结、房室结的自律性，减慢传导速率，延长APD和ERP，治疗室上性和房室结折返引起的心律失常效果好，为阵发性室上性心动过速治疗的首选药。奎尼丁（A错）和普鲁卡因胺（E错）属于适度的钠离子通道阻滞剂，其中奎尼丁为广谱的心律失常药，适用于心房颤动、心房扑动、室上性和室性心动过速的转复和预防，以及频发室上性和室性期前收缩的治疗；普鲁卡因胺为广谱抗心律失常药，对房性、室性心律失常均有效，临床主要用于室性心律失常。利多卡因（C错）属于轻度的钠离子通道阻滞剂，为一窄谱抗心律失常药，对心房作用弱，仅用于治疗室性心律失常，是治疗急性心肌梗死引起的室性心律失常的首选药。普萘洛尔（D错）属于β受体阻断药，适用于治疗与交感神经兴奋有关的各种心律失常，尤其对于交感神经兴奋性过高、甲状腺功能亢进及嗜铬细胞瘤等引起的窦性心动过速效果更好。